患者男性，32岁，6天前感冒后出现左下后牙区胀痛，进食、吞咽时加重。昨日起出现局部自发性跳痛，张口受限，低热，头痛，检查可见：左下颌角区颊部稍肿胀，无压痛，张口度两指，左下第三磨牙近中阻生牙龈红肿充血，挤压可见远中盲袋内少量脓液溢出，颊侧前庭沟丰满、充血，压痛明显、叩诊（-），无松动，咽侧壁稍充血，无压痛。如果下颌升支区脓肿形成而未得到及时引流，约多长时间可造成骨质破坏
A. 7～10天
B. 1～2周
C. 2～4周
D. 4～6周
E. 6周以上

正确答案：C。2～4周

解析：本题考查颌骨骨髓炎。咬肌间隙感染有脓肿形成时若不及时引流，则可发展成慢性边缘性骨髓炎，儿童颌骨骨髓炎一般在7～10天后可开始形成死骨（A错），成人通常需2～4周（C对）才会有骨质破坏。